基于升华原理的干燥方法是
A. 红外干燥
B. 液化床干燥
C. 冷冻干燥
D. 喷雾干燥
E. 微波干燥

正确答案：C。冷冻干燥

解析：本题考查干燥方法的原理。冷冻干燥（C对）又称升华干燥，是指将含水物料冷冻到冰点以下，使水转变为冰，然后在较高真空下将冰转变为蒸气而除去的干燥方法。红外干燥是指利用红外辐射元件所发出来的红外线对物料直接照射加热。流化床干燥是指利用流体化技术对颗粒状固体物料进行干燥。喷雾干燥是指直接把药物溶液喷入干燥室进行干燥。微波干燥是一种介电加热的方法。